从文化的价值取向来看，文化可以分为
A. 显型文化、隐型文化
B. 主文化、亚文化、跨文化
C. 前喻文化、同喻文化、后喻文化
D. 主文化、亚文化、反文化
E. 智能文化、规范文化、思想文化

正确答案：C。前喻文化、同喻文化、后喻文化

解析：本题考查文化按价值取向的分类。从文化的价值取向来看，文化可以分为前喻文化、同喻文化、后喻文化（C对ABDE错）。